原始骨痂的形成一般需要
A. 6～8小时
B. 2周
C. 4～8周
D. 8～12周
E. 12周以上

正确答案：E。12周以上

解析：骨折愈合过程中血肿机化演进期一般约需2周，原始骨痂形成期一般约需3~6个月（E对），骨痂改造塑形期约需1～2年。